阻碍血液输氧，引起组织缺氧的是
A. 臭氧
B. 铅
C. 硒
D. 甲醛
E. 苯并（a）芘

正确答案：A。臭氧

解析：本题考查引起组织缺氧的物质。O₃（A对BCDE错）是一种常见的污染物，它可阻碍血液输氧功能，引起组织缺氧。